SCE实验中，加入BrdU的作用是
A. 使细胞分裂终止于中期相
B. 阻止细胞核分裂
C. 取代胸苷掺入DNA，使姐妹染色体单体差别染色
D. 使细胞分裂同步

正确答案：C。取代胸苷掺入DNA，使姐妹染色体单体差别染色

解析：本题考查SCE实验中加入BrdU的作用。SCE实验是指姐妹染色单体交换实验，在该实验中加入BrdU的作用是取代胸苷掺入DNA，使姐妹染色体单体差别染色（C对ABD错）。